急性右心室ST段抬高心肌梗死慎用
A. 氯吡格雷
B. 呋塞米
C. 阿司匹林
D. 低分子肝素
E. 尿激酶

正确答案：B。呋塞米

解析：右心室梗死的患者，其主要改变是急性右心衰的血流动力学改变，右心衰竭导致右室射入肺循环的血液减少，左心室回心血量减少，心输出量减少，若此时使用利尿剂呋塞米，将进一步减少循环血量，加重患者症状，因此急性右心室ST段抬高心肌梗死慎用呋塞米（B错，本题正确答案）。氯吡格雷（A对）和阿司匹林（C对）都为抗血小板药物，如无禁忌症，均应早期联合使用。低分子肝素（D对）用于患者的抗凝治疗，而尿激酶（P243）（E对）用于患者的溶栓治疗，急性右心室ST段抬高心肌梗死者都可应用。